厥证急救时，首先应分辨
A. 标本
B. 表里
C. 寒热
D. 虚实
E. 气血

正确答案：D。虚实

解析：厥证证不外虚实二证，辨虚实（D对）属性是厥证急救之关键所在。虚者多为气血亏虚，宜急补虚固脱；实证为气滞、血瘀、痰阻、暑闭，宜急芳香开窍。